诱导B细胞发生转换产生IgE的是
A. IL–1
B. IL–2
C. IL–4
D. IL–3
E. IL–6

正确答案：C。IL–4

解析：IL-4诱导B细胞发生19类别转换产生IgE。掌握“细胞因子及受体”知识点。